中国药典规定，凉暗处除避光外温度不应超过
A. 4
B. 10
C. 15
D. 20
E. 30

正确答案：D。20

解析：本题考查药品的贮存。中国药典规定，凉暗处指贮藏处避光且温度不超过20℃（D对）。阴凉处指贮藏处温度不超过20℃。冷处指贮藏处温度为2℃～10℃。常温指温度为10℃～30℃。